患者男，58岁，因慢性阻塞性肺疾病住院1个月，近5天来出现高热、咳痰，伴呼吸困难。实验室检查血肌酐及尿素氮值正常，白细胞计数为12×10⁹/L，中性粒细胞90%，血培养为耐甲氧西林金葡菌，应首选的抗菌药物是
A. 苯唑西林
B. 头孢唑啉
C. 克林霉素
D. 万古霉素
E. 美罗培南

正确答案：D。万古霉素

解析：本题考查慢性阻塞性肺疾病的临床用药。患者男，58岁，因慢性阻塞性肺疾病住院1个月，近5天来出现高热、咳痰，伴呼吸困难。实验室检查血肌酐及尿素氮值正常，白细胞计数为12×10⁹/L，中性粒细胞90%，血培养为耐甲氧西林金葡菌，应首选的抗菌药物是万古霉素（D对）。患者患有慢性阻塞性肺疾病，实验室检查血肌酐及尿素氮值正常说明患者肾功能正常，白细胞计数和中性粒细胞升高，说明患者有急性感染，血培养为耐甲氧西林金葡菌，针对此种情况应首选万古霉素，万古霉素对治疗耐甲氧西林金葡菌有效，与其他抗菌药物无交叉耐药。